血管紧张素受体阻滞剂是
A. 尼卡地平
B. 硝苯地平
C. 氨氯地平
D. 尼莫地平
E. 氯沙坦

正确答案：E。氯沙坦

解析：氯沙坦是血管紧张素受体阻滞剂（E对），在受体水平阻断RAS，与ACE抑制剂比较具有作用专一的特点，临床主要用于高血压的治疗。尼卡地平、硝苯地平、氨氯地平、尼莫地平均属于钙通道阻滞剂（ABCD错）。